对所假设的病因或流行因素进一步在选择的人群中探索疾病发生的条件和规律，验证病因假设属于口腔流行病学研究方法中的
A. 描述性流行病学
B. 分析性流行病学
C. 实验性流行病学
D. 口腔疾病的一般统计
E. 口腔流行病学调查

正确答案：B。分析性流行病学

解析：本题目主要考查口腔流行病学的研究方法。对所假设的病因或流行因素进一步在选择的人群中探索疾病发生的条件和规律，验证病因假设属于口腔流行病学研究方法中的分析性流行病学（B对）。描述性流行病学（A对）是流行病学中最常用的一种，用于描述疾病或健康现象在人群中的分布以及发生、发展规律，并提出病因假设。实验流行病学（C错）又称流行病学实验，是指在研究者的控制下对人群采取某项干预措施以观察其对人群疾病或健康状态的影响。主要用于：①验证病因假设；②预防措施的效果与安全性评价；③新药、新方法或新制剂的效果和安全性评价；④成本效果评价和成本效益分析。口腔疾病的一般统计（D错）、口腔流行病学调查（E错）均与题干不符。